皮样囊肿属于
A. 软组织囊肿
B. 牙源性颌骨囊肿
C. 非牙源性颌骨囊肿
D. 血外渗性囊肿
E. 瘤样病变

正确答案：A。软组织囊肿

解析：皮样或表皮样囊肿属于软组织囊肿。掌握“牙源性颌骨囊肿”知识点。